社区应包括的要素是
A. 有相对固定的人群
B. 有一定的地域范围
C. 有必需的生活服务设施
D. 特有的文化背景、生活方式和认同意识
E. 以上均包括

正确答案：E。以上均包括

解析：一般来说，社区应包括五个要素：①有相对固定的人群；②有一定的地域范围；③有必需的生活服务设施；④特有的文化背景、生活方式和认同意识；⑤相应的生活制度和管理机构。在以上共同特征的基础上，可产生共同的社区意识，相互之间有强烈的认同感、归属感和凝聚力，可相互合作并开展有组织的集体活动，为完成共同的目标而努力，以此来满足所在社区的共同需要。掌握“社区口腔卫生服务”知识点。